我国卫生部对现代生殖技术应用做出的规定是
A. 不得实施夫精人工授精技术
B. 不得实施试管婴儿技术
C. 不得实施多胎减胎术
D. 不得实施代孕技术
E. 不得实施异源人工授精技术

正确答案：D。不得实施代孕技术

解析：我国卫生部对现代生殖技术应用做出的规定是不得实施代孕技术（E对）。